抑制胃酸分泌作用最强的是
A. 西咪替丁
B. 雷尼替丁
C. 奥美拉唑
D. 哌仑西平
E. 丙谷胺

正确答案：C。奥美拉唑